“六淫”是指
A. 六种自然界的气候变化
B. 六种时令疫邪
C. 六种外感病邪的总称
D. 六种病理产物
E. 六种内在致病因素

正确答案：C。六种外感病邪的总称

解析：六淫，即风、寒、暑、湿、燥、火（热）六种外感病邪的总称（C对）。